无细胞外源性纤维牙骨质与有细胞固有纤维牙骨质不规则交替沉积形成的是
A. 无细胞无纤维牙骨质
B. 无细胞外源性纤维牙骨质
C. 有细胞固有纤维牙骨质
D. 无细胞固有纤维牙骨质
E. 有细胞混合性分层牙骨质

正确答案：E。有细胞混合性分层牙骨质

解析：有细胞混合性分层牙骨质为无细胞外源性纤维牙骨质和有细胞固有纤维牙骨质不规则交替沉积而成，通常分布在根分歧区及根尖区。掌握“牙骨质”知识点。